下列治疗巅顶痛的药物是
A. 藁本
B. 川芎
C. 柴胡
D. 白芷
E. 羌活

正确答案：A。藁本

解析：藁本辛温香燥，性味俱升，善达巅顶，以发散太阳经风寒湿邪见长，并有较好的止痛作用，常用治太阳风寒，循经上犯，症见头痛、鼻塞、巅顶痛甚者，每与羌活、苍术、川芎等祛风湿、止痛药同用（A对）。川芎秉性升散，其能“上行头目”，既能活血行气止痛，又长于祛风止痛，为治头痛之要药（B错）。柴胡善治少阳经头痛，疼痛部位在侧头部（C错）。白芷辛散温通，长于止痛，且善入足阳明胃经，善治阳明头痛（D错）。羌活辛温发散，气味雄烈，善于升散发表，有较强的解表散寒，祛风胜湿，止痛之功，善治太阳经头痛（E错）。